囊肿的囊壁较薄，囊腔内含有牙冠，囊壁附着于牙颈部，囊液多呈黄色；镜下见纤维结缔组织囊壁，类似于缩余釉上皮；纤维囊壁内炎症不明显，为以下哪种疾病的病理表现
A. 萌出囊肿
B. 根尖周囊肿
C. 含牙囊肿
D. 复发性腮腺炎
E. 急性化脓性颌骨骨髓炎

正确答案：C。含牙囊肿

解析：含牙囊肿的囊壁较薄，囊腔内含有牙冠，囊壁附着于牙颈部，囊液多呈黄色；镜下见纤维结缔组织囊壁内衬较薄的复层扁平上皮，仅由2～5列扁平细胞或矮立方细胞构成，无角化，无上皮钉突，类似于缩余釉上皮；纤维囊壁内炎症不明显。掌握“牙源性囊肿”知识点。